某男，48岁，突患急性支气管炎，症见身热口渴，咳嗽痰盛，喘促气逆，胸膈满闷，医师诊断为表寒里热之咳喘。根据医师判断，适宜患者服用的成药是
A. 蠲哮片
B. 杏苏止咳颗粒
C. 蛤蚧定喘胶囊
D. 桂龙咳喘宁胶囊
E. 止嗽定喘口服液

正确答案：E。止嗽定喘口服液

解析：本题考查的是止嗽定喘口服液的主治。突患急性支气管炎，症见身热口渴，咳嗽痰盛，喘促气逆，胸膈满闷，医师诊断为表寒里热之咳喘。根据医师判断，适宜患者服用的成药是止嗽定喘口服液（E对）。止嗽定喘口服液：【主治】表寒里热，身热口渴，咳嗽痰盛，喘促气逆，胸膈满闷；急性支气管炎见上述证候者。蠲哮片（A错）：【主治】支气管哮喘急性发作期痰瘀伏肺证，症见气粗痰涌、痰鸣如吼、咳呛阵作、痰黄稠厚。杏苏止咳颗粒（B错）：【主治】风寒感冒咳嗽、气逆。蛤蚧定喘胶囊（C错）：【主治】肺肾两虚、阴虚肺热所致的虚劳久咳、年老哮喘、气短烦热、胸满郁闷、自汗盗汗。桂龙咳喘宁胶囊（D错）：【主治】外感风寒，痰湿内阻引起的咳嗽、气喘、痰涎壅盛；急、慢性支气管炎见上述证候者。